用药期间饮酒可能出现“双硫仑样反应”的药物是
A. 头孢哌酮
B. 万古霉素
C. 美罗培南
D. 克拉霉素
E. 左氧氟沙星

正确答案：A。头孢哌酮

解析：本题考查药物的不良反应。用药期间饮酒可能出现“双硫仑样反应”的药物是头孢哌酮（A对）。头孢哌酮抑制肝药酶的活性，干扰乙醇的代谢，使血中的乙醛浓度增高，出现“双硫仑样反应”。万古霉素（B错）不宜肌内注射或直接静脉注射，滴注速度过快易出现“红人综合征”。美罗培南（C错）不良反应为局部交叉过敏反应。克拉霉素（D错）为肝药酶抑制剂，与经过CYP3A4酶代谢药物合用，会增加药物不良反应。左氧氟沙星（E错）不良反应为心脏Q-T间期延长。